关于雷尼替丁，哪项错误
A. 是H₂受体阻断药
B. 抑制胃酸分泌作用比西咪替丁强
C. 也能中和胃酸，减轻对溃疡面的刺激
D. 肝功不良者t½明显延长
E. 对基础胃酸和夜间胃酸分泌都抑制

正确答案：C。也能中和胃酸，减轻对溃疡面的刺激